糖尿病患者，女，65岁，家庭主妇，初中文化程度。医生给予的饮食建议，容易理解和执行的说法是
A. “您每天摄入热量不能超过1200千卡。”
B. “您必须严格控制饮食，要低盐、低脂、低糖饮食。”
C. “每顿饭主食2两，少吃油腻的。”
D. “不吃甜食。稀饭、甘蔗、西瓜、甜饮料，少吃肉、油，可吃点粗粮。”
E. “您一定要管住自己的嘴，原来爱吃的都不能吃了。”

正确答案：D。“不吃甜食。稀饭、甘蔗、西瓜、甜饮料，少吃肉、油，可吃点粗粮。”

解析：患者家庭主妇，初中文化程度，文化程度低且与主要接触的是生活中的锁事，通常对医学信息及医学术语所知有限，应用通俗易懂的用语方利于其理解和执行，故应采取的说法是“不吃甜食。稀饭、甘蔗、西瓜、甜饮料，少吃肉、油，可吃点粗粮”（D对）。“您每天摄入热量不能超过1200千卡”（A错）、“您必须严格控制饮食，要低盐、低脂、低糖饮食”（B错）、“每顿饭主食2两，少吃油腻的”（C错）说法有大量专业术语，适用于文化层次高，对医学、健康营养知识有一定了解的人。“您一定要管住自己的嘴，原来爱吃的都不能吃了”（E错）说法太过笼统武断，不准确。